下列有关氯丙嗪对体温调节的作用的描述中，正确的是
A. 不仅降低发热体温，也降低正常体温
B. 对下丘脑体温调节中枢有很强的抑制作用
C. 环境温度愈低其降温作用愈显著
D. 临床上配合物理降温用于低温麻醉
E. 以上都是正确

正确答案：E。以上都是正确

解析：氯丙嗪对体温调节的作用：氯丙嗪对下丘脑体温调节中枢有很强的抑制作用，不但降低发热机体的体温，也能降低正常体温。氯丙嗪的降温作用随外界环境温度而变化，环境温度愈低其降温作用愈显著，与物理降温同时应用，则有协同降温作用；在炎热天气，氯丙嗪却可使体温升高，这是其干扰了机体正常散热机制的结果。掌握“氯丙嗪”知识点。